灰婴综合征属于哪种药物的不良反应
A. 青霉素
B. 红霉素
C. 氯霉素
D. 克拉霉素
E. 阿奇霉素

正确答案：C。氯霉素

解析：氯霉素（C对）大剂量使用易引起中毒，表现为腹胀、呕吐、呼吸抑制乃至皮肤灰白、紫紺，最后循环衰竭、休克，称灰婴综合征，主要是由于新生儿和早产儿肝脏的葡萄糖醛酸转移酶缺乏，切肾脏排泄功能不完善，对氯霉素解毒能力差，一般发生于治疗的第2天至第9天，症状出现2天内死亡率可高达40%。青霉素（A错）属于β₂-内酰胺类抗生素，其主要不良反应为过敏反应，使用时应详细询问过敏史，注射前必须做皮肤过敏试验等。红霉素（B错）、克拉霉素（D错）、阿奇霉素（E错）均属于大环内脂类抗生素，可抑制细菌蛋白质的合成，其中红霉素常见的不良反应主要有胃肠道反应、血栓性静脉炎、肝毒性和过敏反应；阿奇霉素不良反应发生率较红霉素低，主要为轻中度胃肠道反应，偶见肝功能异常与轻度中性粒细胞减少症；克拉霉素主要不良反应为胃肠道反应，偶可发生皮疹、皮肤瘙痒及头痛等。